原发性高血压时细动脉可逆性病理改变是
A. 血管壁平滑肌萎缩
B. 血管纤维化
C. 血管痉挛
D. 内膜下蛋白性物质沉积
E. 血管腔狭窄

正确答案：C。血管痉挛

解析：原发性高血压时，细动脉可逆性病理改变（即是非器质性病理改变）为细小动脉间歇性痉挛收缩（C对）。内膜下蛋白性物质沉积（D错）和血管腔狭窄（E错）属于高血压动脉病变期的病理改变。血管壁平滑肌萎缩（A错）和血管纤维化（B错）属于高血压内脏病变期（P140-P141）。